治疗中风闭证，除选太冲、劳宫外还应为
A. 水分
B. 水沟
C. 下关
D. 中冲
E. 丰隆

正确答案：B。水沟

解析：中风病的闭证应在主穴水沟、内关、百会基础上选用平肝熄风、清心豁痰、醒脑开窍的十二井穴、水沟、太冲等穴位（B对）。